初孕妇，妊娠38周，妊高征头痛眼花1周，尿蛋白（+++），尿雌三醇5.9mg/24h，监护结果：胎心晚期减速，此时恰当处理是
A. 改善胎盘功能，维持妊娠
B. 治疗妊高征待症状好转后剖官产
C. 治疗妊高征的同时立即剖宫产
D. 催产素引产
E. 治疗妊高征待病情好转后引产

正确答案：C。治疗妊高征的同时立即剖宫产

解析：尿雌三醇测定正常范围：正常妊娠29周尿E3迅速增加，正常足月妊娠E3排出量平均值为88.7nmol/24h（24.2mg/24h）。临床意义：减少正常足月妊娠E3含量，连续多次均在37nmol/24h（10mg/24h）以下，提示胎盘功能减退；在22.2nmol/24h（6mg/24h）以下，提示胎盘功能显著减退。胎心晚期减速提示胎儿窘迫，再加上胎盘功能显著减退，所以此时应立即剖宫产。掌握“娠期高血压疾病”知识点。